《中国药典》中，五味子质量控制成分的结构类型是
A. 三萜皂苷
B. 黄酮苷
C. 木脂素
D. 甾体皂苷
E. 二萜皂苷

正确答案：C。木脂素

解析：本题考查五味子的化学成分。《中国药典》中，五味子质量控制成分的结构类型是木脂素（C对）。含木脂素类化合物五味子：含木脂素较多，约为5%，近年来从其果实中分得了一系列联苯环辛烯型木脂素，包括五味子醇和五味子素。《中国药典》采用高效液相色谱法测定五味子药材中五味子醇甲的含量，要求不得少于0.40%。柴胡中含有的总皂苷为1.6%～3.8%。柴胡中所含皂苷均为三萜皂苷（A错），柴胡皂苷是柴胡的主要有效成分。《中国药典》以柴胡皂苷a和柴胡皂苷d为指标成分对柴胡药材进行含量测定，要求两者的总含量不得少于0.30%。含黄酮苷（B错）类化合物葛根：葛根含异黄酮类化合物，主要成分有大豆素、大豆苷、大豆素-7，4’-二葡萄糖苷及葛根素、葛根素-7-木糖苷。《中国药典》以葛根素为指标成分对葛根进行含量测定，要求含葛根素不得小于2.4%。含甾体皂苷（D错）类化合物麦冬：主要包括麦冬皂苷A、麦冬皂苷B等。《中国药典》以鲁斯可皂苷元为对照品，测定麦冬中麦冬总皂苷含量，要求含量不得少于0.12%。穿心莲叶中含有多种二萜内酯（E错）及二萜内酯苷类成分，如穿心莲内酯、新穿心莲内酯、14-去氧穿心莲内酯、脱水穿心莲内酯等。其中穿心莲内酯含量最高，为其主要活性成分。《中国药典》以穿心莲内酯、新穿心莲内酯，14-去氧穿心莲内酯、脱水穿心莲内酯为指标成分对穿心莲进行含量测定。